根据药品广告审查发布标准，不得发布广告的药品为
A. 处方药
B. 非处方药
C. 放射性药品
D. 中药材
E. 中药饮片

正确答案：C。放射性药品

解析：本题考查不得发布广告的产品。根据药品广告审查发布标准，不得发布广告的药品为放射性药品（C对）。不得发布广告的产品：按照规定，不得做广告的产品包括：①麻醉药品、精神药品、医疗用毒性药品、放射性药品、药品类易制毒化学品，以及戒毒治疗的药品、医疗器械；②军队特需药品、军队医疗机构配制的制剂；③医疗机构配制的制剂；④依法停止或者禁止生产、销售或者使用的药品、医疗器械、保健食品和特殊医学用途配方食品；⑤法律、行政法规禁止发布广告的情形。